按照《处方药与非处方药分类管理办法（试行）》，经批准的商业企业无需具有《药品经营许可证》就可以
A. 批发经营甲类非处方药
B. 批发经营乙类非处方药
C. 零售经营乙类非处方药
D. 零售经营甲类非处方药
E. 零售经营非处方药

正确答案：C。零售经营乙类非处方药

解析：本题考查处方药与非处方药分类管理办法。经批准的商业企业无需具有《药品经营许可证》就可以零售经营乙类非处方药（C对）。经营处方药、非处方药的批发企业和经营处方药、甲类非处方药的零售企业必须具有《药品经营企业许可证》。